胸胁苦满属于
A. 半表半里证
B. 表证
C. 里证
D. 阳证
E. 里证

正确答案：A。半表半里证

解析：半表半里证在六经辨证中通常称为少阳病症，由于少阳之脉布于胁肋，邪郁少阳，经气不利，故出现胸胁苦满的症状（A对）。表证表现为新起恶风寒，或恶寒发热，头身疼痛，喷嚏，鼻塞，流涕，咽喉痒痛，微有咳嗽、气喘，舌淡红，苔薄，脉浮（B错）。里证表现为无新起恶寒发热并见，以脏腑症状为主要表现（C错）。阳证表现为面色红赤，恶寒发热，肌肤灼热，神烦，躁动不安，语声粗，呼吸气粗，喘促痰鸣，口干渴饮，大便秘结，小便涩痛，短赤，舌质红绛，苔黄黑生芒刺，脉象浮数、洪大、滑实（D错）。阴证表现为面色苍白，精神萎靡，畏冷肢凉，倦怠无力，语声低怯，口淡不渴，小便清长或短少，大便溏泻，舌淡胖嫩，脉沉迟、微弱、细（E错）。